药物测量紫外分光光度的范围是
A. ＜200nm
B. 200～400nm
C. 400～760nm
D. 760～2500nm
E. 2.5㎛～25㎛

正确答案：B。200～400nm

解析：本题考查紫外分光光度法。光谱分析法所用的波长范围包括从紫外光区至红外光区。光谱范围大致分为紫外区（190～400nm）（B对A错）、可见区（400～760nm）（C错）、近红外区（760～2500nm）（D错）、红外区（2.5μm～40μm或4000～250cm⁻¹）（E错）。